多巴胺药理作用不包括
A. 激动心脏β₁受体
B. 促进去甲肾上腺素的释放
C. 激动血管α受体
D. 激动血管多巴胺受体
E. 大剂量可使肾血管舒张

正确答案：E。大剂量可使肾血管舒张

解析：多巴胺对肾脏有双重作用即低浓度时作用于多巴胺D₁受体，舒张肾血管，使肾血流量增加，肾小球的滤过增加，尿量增加，大剂量时兴奋肾血管的α受体（C对），使肾血管明显收缩（E错，为本题正确答案）。多巴胺是去甲肾上腺素合成的前体，故可以促进去甲肾上腺素的释放（B对）。多巴胺低浓度时，主要与肾脏、肠系膜和冠状的多巴胺受体结合（D对），通过激活腺苷酸环化酶，使细胞内cAMP水平提高而导致血管舒张，高浓度的多巴胺可作用于心脏β₁受体（A对），使心肌收缩力增强，心排出量增加。